女，60岁。反复咳嗽咳痰25年，心悸气促下肢间歇水肿3年，病情加重伴畏寒发热1周入院。体检：T38℃，呼吸急促，口唇发绀，双肺叩诊过清音，中下肺闻及湿啰音，心率110次/分，心律齐，无杂音，双下肢重度水肿。假设该病例呼吸困难突然进一步加重，右肺呼吸音明显较前减弱，应立即进行的检查是
A. 动脉血气分析
B. 胸腔B超
C. 胸部X线
D. 心电图
E. 肺功能

正确答案：C。胸部X线

解析：患者为老年女性，反复咳嗽咳痰25年，口唇发绀，双肺叩诊过清音，中下肺闻及湿啰音，考虑诊断为慢性阻塞性肺疾病（COPD）。COPD患者呼吸困难突然加重，右肺呼吸音明显较前减弱，应考虑并发自发性气胸，通过X线检查（C对）可以确诊，可显示肺受压程度，肺内病变情况等。动脉血气分析（A错）多在病人昏迷、病情危重时了解病情严重程度以及判断呼吸衰竭的类型。胸腔B超（B错）探测胸腔积液的灵敏度高，定位准确，用于胸腔积液的检查。心电图（D错）主要是了解各种心律失常、心肌缺血/梗死、房室肥大或电解质紊乱等。肺功能（E错）用于诊断慢阻肺，并且要求患者可以配合做呼吸运动，该患者呼吸困难加重，不适合做肺功能检查。